中国药典（一部）规定，防己薄层色谱鉴别使用的对照品有
A. 药根碱
B. 粉防己碱
C. 防己诺林碱
D. 去甲基粉防己碱
E. 轮环藤酚碱

正确答案：B、C。粉防己碱；防己诺林碱